根据《药品经营质量管理规范》，药品零售企业应当加强对所售药品的陈列管理，关于药品陈列要求的说法，正确的是
A. 药品应当按剂型、用途、包装规格及储存温度要求分类陈列
B. 不得陈列毒性中药饮片、罂粟壳以及国家有专门管理要求的药品
C. 需阴凉贮藏的药品不得陈列于冷藏柜中
D. 对营业场所温度进行监测和调控，以使营业场所的温度符合常温要求

正确答案：D。对营业场所温度进行监测和调控，以使营业场所的温度符合常温要求

解析：本题考查药品陈列要求。根据《药品经营质量管理规范》，药品零售企业应当加强对所售药品的陈列管理，关于药品陈列要求的说法，正确的是对营业场所温度进行监测和调控，以使营业场所的温度符合常温要求（D对）。《药品经营质量管理规范》第一百五十九条规定，企业应当对营业场所温度进行监测和调控，以使营业场所的温度符合常温要求。第一百六十一条规定，药品的陈列应当符合以下要求：（一）按剂型、用途以及储存要求分类陈列（A错），并设置醒目标志，类别标签字迹清晰、放置准确。（二）药品放置于货架（柜），摆放整齐有序，避免阳光直射。（三）处方药、非处方药分区陈列，并有处方药、非处方药专用标识。（四）处方药不得采用开架自选的方式陈列和销售。（五）外用药与其他药品分开摆放。（六）拆零销售的药品集中存放于拆零专柜或者专区。（七）第二类精神药品、毒性中药品种和器粟壳不得陈列（B错）。（八）冷藏药品放置在冷藏设备中，按规定对温度进行监测和记录，并保证存放温度符合要求（C错）。（九）中药饮片柜斗谱的书写应当正名正字；装斗前应当复核，防止错斗、串斗；应当定期清斗，防止饮片生虫、发霉、变质；不同批号的饮片装斗前应当清斗并记录。（十）经营非药品应当设置专区，与药品区隔离，并有醒目标志。